属非磺酰脲类促胰岛素分泌剂的药物是
A. 瑞格列奈
B. 格列本脲
C. 罗格列酮
D. 二甲双胍
E. 阿卡波糖

正确答案：A。瑞格列奈

解析：本题考查非磺酰脲类胰岛素分泌促进剂类降糖药。瑞格列奈（A对）是氨甲酰甲基苯甲酸的衍生物，属非磺酰脲类促胰岛素分泌剂。格列本脲（B错）为磺酰脲类胰岛素分泌促进剂。罗格列酮（C错）、二甲双胍（D错）均为胰岛素增敏剂。阿卡波糖（E错）为α-葡萄糖苷酶抑制剂。